成骨性骨肉瘤的重要标志之一
A. 瘤骨形成
B. 骨髓腔扩大
C. 骨小梁增生
D. 软组织区病变
E. 牙槽骨水平吸收

正确答案：A。瘤骨形成

解析：本题考查成骨性骨肉瘤。成骨性骨肉瘤的重要标志之一瘤骨形成（A对）。瘤骨形成：是成骨性骨肉瘤的重要标志之一。瘤骨表现为斑片状和日光放射状，前者可见于肿瘤中心区或颌骨周围的软组织区，后者一般由肿瘤中心向外伸展，长短粗细不齐。